男，70岁。服用氟桂利嗪3个月后出现动作徐缓，僵硬，手部震颤，跌倒一次。美多芭治疗无效。查体：智能正常，面具脸，四肢肌力正常，肌张力高。最可能的诊断是
A. 血管性帕金森综合征
B. 帕金森叠加综合征
C. 药物性帕金森综合征
D. 外伤性帕金森综合征
E. 原发性帕金森病

正确答案：C。药物性帕金森综合征

解析：继发性帕金森综合征多是由药物、感染、中毒、脑卒中、外伤等明确病因所致。其中，由于服用多巴胺能耗竭剂或具多巴胺受体拮抗作用的抗精神病药或钙离子拮抗剂（如氟桂利嗪）引起帕金森症状，称为药物性帕金森综合症。氟桂利嗪可阻断钙离子内流，同时对内源性多巴胺具有阻滞作用，在用药数周或数月后可出现帕金森综合症。该患者服用氟桂利嗪3个月后出现动作徐缓，僵硬，手部震颤等帕金森症状，则最可能的诊断为药物性帕金森综合症（C对）。血管性帕金森综合症（A错）多是由多发性脑梗死、低血压性休克引起的，应具有原发病的表现。帕金森叠加综合征（B错）的表现类似帕金森病，但程度重，病变广，对左旋多巴治疗反应不佳，包括多系统萎缩、进行性核上性麻痹和皮质基底节变性、路易体痴呆等。外伤性帕金森综合症（D错）如拳击性脑病，多有明确的脑部外伤病史。原发性帕金森病（E错）无明确病因，临床上以静止性震颤、运动迟缓、肌强直和姿势平衡障碍为主要特征，对美多芭治疗敏感。